口服后可以通过血脑屏障进入脑脊液中的三氮唑类抗真菌药物是
A. 酮康唑
B. 氟康唑
C. 硝酸咪康唑
D. 特比萘芬
E. 制霉菌素

正确答案：B。氟康唑

解析：本题考查抗真菌药的作用特点。氟康唑（B对）结构中含有两个弱碱性的三氮唑环和一个亲脂性的2，4-二氟苯基，使其具有一定的脂溶解度。这种结构使氟康唑口服吸收可达90%，且不受食物、抗酸药、组胺H₂受体阻断剂类抗溃疡药物的影响；作用强，可透过血-脑屏障，是治疗深部真菌感染的首选药。